女，65岁。外阴瘙痒五年，近两个月伴局部疼痛，阴蒂右侧部位可见直径约2.5cm的肿物，活检组织病理学诊断为鳞状细胞癌。正确的分期是
A. ⅠA
B. ⅠB
C. Ⅱ
D. Ⅲ
E. Ⅳ

正确答案：B。ⅠB

解析：患者外阴瘙痒，疼痛，阴蒂右侧部位见直径约2.5cm的肿物（肿瘤最大径线＞2cm或间质浸润＞1.0mm，局限于外阴或会阴，无淋巴结转移），活检组织病理学诊断为鳞状细胞癌，提示患者为外阴鳞状细胞癌ⅠB期（B对）。ⅠA期（A错）为肿瘤最大径线≤2cm，局限于外阴或会阴且间质浸润≤1.0mm，无淋巴结转移。Ⅱ期（C错）为肿瘤侵犯会阴邻近结构（下1/3尿道、下1/3阴道、肛门），无淋巴结转移。Ⅲ期（D错）任何大小的肿瘤，有或无侵犯会阴邻近结构（下1/3尿道、下1/3阴道、肛门），有腹股沟-股淋巴结转移。Ⅳ期（E错）为肿瘤侵犯上2/3尿道或上2/3阴道，或远处转移。